关于睾丸结构的描述，错误的是
A. 白膜为睾丸表面的纤维膜
B. 睾丸纵隔为白膜于睾丸后缘增厚，并深人睾丸实质而形成
C. 精曲小管上皮能产生精子
D. 睾丸网由睾丸输出小管互相吻合而成
E. 无

正确答案：D。睾丸网由睾丸输出小管互相吻合而成

解析：睾丸表面覆盖浆膜及白膜（A对）、睾丸纵膈由白膜在睾丸后缘增厚进入睾丸形成（B对）、精子由生精小管的生精上皮产生（C对）。睾丸网由生精小管汇合成精直小管（D错，为本题正确答案）互相吻合而成，而不是睾丸输出小管。